洗涤剂表面活性剂毒性最小的是
A. 助洗剂
B. 离子型
C. 阳离子型
D. 阴离子型
E. 非离子型

正确答案：E。非离子型

解析：本题考查表面活性剂毒性最小的洗涤剂。洗涤剂表面活性剂毒性最小的是非离子型（E对AB错），表面活性剂毒性较大的是阳离子型（C错），阴离子型（D错）毒性介于两者之间。